属于我国水环境质量标准范畴的是
A. 《生活饮用水卫生标准》（GB 5749-2006）
B. 《农田灌溉水质标准》（GB 5084-2005）
C. 《渔业水质标准》（GB 11607-1989）
D. 《地表水环境质量标准》（GB 3838-2002）
E. 以上都是

正确答案：E。以上都是

解析：本题考查我国水环境质量标准的相关内容。水环境质量标准主要由《地表水环境质量标准》（GB 3838-2002）和系列标准如《渔业水质标准》（GB 11607-1989）、《农田灌溉水质标准》（GB 5084-2005）、《海水水质标准》（GB 3097-1997）、《地下水水质标准》（GB/T 14848-1993）、《生活饮用水卫生标准》（GB 5749-2006）等组成（E对ABCD错）。